男，78岁。晨起四肢乏力。2小时前行走中跌倒，不能起立。体检：意识清楚，只能以眼球上下运动示意。双侧周围性面瘫，张口伸舌和吞咽不能，留置鼻饲。四肢肌力0级，腱反射亢进，双侧Babinski征阳性。感觉无异常。脑梗死部位在
A. 中脑
B. 脑桥基底部
C. 内囊后肢
D. 丘脑底部
E. 基底节区

正确答案：B。脑桥基底部

解析：患者老年男性，晨起四肢乏力，体检意识清楚，只能以眼球上下运动示意（双侧动眼神经与滑车神经功能保留，双侧展神经功能受损），双侧周围性面瘫（双侧面神经核团以下受损），张口伸舌和吞咽不能，留置鼻饲（双侧舌咽神经受损出现舌、咽及吞咽运动障碍），四肢肌力0级，腱反射亢进，双侧Babinski征阳性（四肢上运动神经元性瘫痪），感觉无异常。根据临床表现可以诊断为闭锁综合症，可确定梗死部位在双侧脑桥基底部（B对）。梗死部位在中脑（A错）均会导致动眼神经麻痹，而出现患侧除外直肌和上斜肌以外的眼外肌运动障碍，瞳孔散大。梗死部位在内囊后肢（C错）会出现病灶对侧偏瘫、偏深感觉障碍、偏盲典型的“三偏”症状（P9）。梗死部位在丘脑底部（D错）主要表现为对侧感觉缺失和刺激症状，对侧不自主运动，并可有感情与记忆障碍（P11）。梗死部位在基底节区（E错）主要表现为运动异常（动作增多或减少）和肌张力改变（增高或减低）（P10）。